脐下4寸，前正中线旁开2寸是
A. 水道
B. 归来
C. 梁门
D. 天枢
E. 大横

正确答案：B。归来

解析：归来位于脐下4寸，前正中线旁开2寸（B对）。水道位于脐下3寸，前正中线旁开2寸（A错）。梁门位于脐上4寸，前正中线旁开2寸（C错）。天枢位于脐中旁开2寸（D错）。大横位于脐中旁开4寸（E错）。